休克期微循环变化的特征是
A. 微动脉端收缩，微静脉端舒张
B. 微静脉端收缩，微静脉端收缩
C. 微静脉端舒张，微静脉端舒张
D. 微动脉端舒张，微静脉端收缩
E. 微动脉端舒张程度大于微静脉端舒张

正确答案：E。微动脉端舒张程度大于微静脉端舒张

解析：休克期即微循环淤血期，此期微动脉、后微动脉和毛细血管前括约肌收缩性减弱甚至扩张，大量血液涌入真毛细血管网。微静脉虽也表现为扩张，但因血流缓慢，细胞嵌塞，使微循环流出道阻力增加，毛细血管后阻力大于前阻力，也就是微动脉端舒张程度大于微静脉端舒张（E对ABCD错）而导致血液淤滞于微循环中。